患者，女性，7岁。左上颈部肿物1年，有反复消长史，特别是感冒时增大。临床触质软，囊性感明显，穿刺液为透明、淡黄色水样清亮液体。最有可能的诊断为
A. 囊性水瘤
B. 颌下腺囊肿
C. 舌下腺囊肿口外型
D. 第二鳃裂囊肿
E. 甲状舌管囊肿

正确答案：A。囊性水瘤

解析：本题考查淋巴管畸形。根据题干，患者为7岁女性，左上颈部囊性肿物，穿刺液为透明、淡黄色水样清亮液体，最有可能是囊性水瘤（A对）。舌下腺囊肿口外型（C错）穿刺可抽出蛋清样粘稠液体。甲状舌管囊肿（E错）常发生于颈正中线，自舌盲孔至胸骨切迹间的任何部位，但以舌骨上下部位最常见，穿刺检查可抽出透明、微浑浊的黄色稀薄或黏稠性液体。第二鳃裂囊肿（D错）常见于20～50岁，多位于颈上部，大多在舌骨水平，胸锁乳突肌上1/3前缘附近，穿刺抽吸时可见黄色或棕色的、清亮的、含或不含胆固醇的液体。唾液腺囊肿一般多发生于小唾液腺和舌下腺，颌下腺囊肿（B错）少见。